牙周袋探诊时使用的力量为
A. 10～20g
B. 20～25g
C. 25～30g
D. 30～35g
E. 35～40g

正确答案：B。20～25g

解析：本题考查牙周探诊。牙周探诊的目的是探测牙龈出血情况、探测龈下牙石、探测牙龈沟或牙周袋的深度。探诊时要掌握适宜的力度一般掌控在20～25g（B对）的探诊压力为好，此力度大约是轻压指甲盖至发白或探入指甲盖内不疼，要做到既探测到实际深度又不致使患者疼痛和损伤。力度不可过大（CDE错），否则会破坏生物学宽度使患者疼痛，力度也不可过小（A错）否则会导致探诊深度比实际深度偏小。